健康教育与卫生宣教的关系是
A. 同等关系
B. 并行关系
C. 先后关系
D. 包容与被包容关系
E. 毫无关系

正确答案：D。包容与被包容关系